抑制细菌依赖性DNA的RNA聚合酶，阻碍mRNA合成的药物是
A. 磺胺嘧啶
B. 氧氟沙星
C. 利福平
D. 两性霉素
E. 红霉素

正确答案：C。利福平

解析：本题考查利福平的作用机制。抑制细菌依赖性DNA的RNA聚合酶，阻碍mRNA合成的药物是利福平（C对）。利福平的抗菌作用机制：抑制病原体依赖DNA的RNA聚合酶，与敏感菌依赖DNA的RNA聚合酶β亚单位牢固结合，抑制病原体RNA合成的起始阶段，抑制细菌RNA的合成。磺胺嘧啶（A错）的作用机制：磺胺药的化学结构与PABA极其相似，通过与PABA竞争性抑制二氢蝶酸合酶，阻碍二氢叶酸的形成，从而影响核酸的合成，最终抑制细菌的生长繁殖。氧氟沙星（B错）的作用机制：喹诺酮类药物抗革兰阴性菌的主要机制是抑制细菌的DNA回旋酶，从而干扰细菌的DNA复制。两性霉素B（D错）的作用机制：两性霉素B为多烯类抗真菌药物，其主要作用机制为通过与敏感真菌细胞膜上的固醇相结合，损伤细胞膜的通透性，导致细胞内的一些重要物质外漏，从而破坏细胞的正常代谢，抑制真菌生长。红霉素（E错）的作用机制：红霉素为大环内酯类抗生素，通过与核糖体的50S亚基结合，抑制移位酶，从而抑制细菌蛋白质的合成。